正确描述肠系膜的是
A. 是将肠管与腹壁、盆壁连接的双层腹膜结构
B. 其附着于肠管的部分称肠系膜根
C. 肠系膜根长约45cm
D. 肠缘长达2～3m
E. 内含肠系膜上血管及其分支

正确答案：E。内含肠系膜上血管及其分支

解析：肠系膜是将空肠和回肠与腹后壁连接的双层腹膜结构(A错)，其附着于腹后壁的部分称肠系膜根(B错)，长约15cm(C错)，肠缘长达5～7m(D错)，肠系膜内含肠系膜上血管及其分支(E对)。